鉴别急性与慢性肾衰首选的检查是
A. 同位素肾动态显像
B. 内生肌酐清除率
C. 尿钠排泄分数
D. 尿沉渣镜检
E. 肾脏B超

正确答案：E。肾脏B超

解析：急性肾损伤（以往称急性肾衰竭）与慢性肾衰竭的鉴别主要从两个方面进行。其一是病史，急性肾损伤是指由多种病因引起的肾功能快速下降而出现的临床综合征，一般病程＜3个月；慢性肾衰竭指各种原因引起的肾脏结构和功能障碍≥3个月。其二是根据影像学检查，急性肾损伤因病程较短形态学的改变不明显，慢性肾衰竭由于长期肾功能受损，可见肾脏明显变形缩小。因此，鉴别急性与慢性肾衰首选的检查是肾脏B超（E对）。同位素肾动态显象（A错）主要用来评价分肾功能。内生肌酐清除率（B错）主要用来判断肾小球损害程度、评估肾功能、指导治疗。尿钠排泄分数（C错）主要用来鉴别肾前性急性肾衰和急性肾小管坏死。尿沉渣镜检（D错）主要通过分析尿液成分，判断泌尿系统受损部位。